阿司匹林可用于缓解
A. 癌性疼痛
B. 分娩疼痛
C. 内脏绞痛
D. 严重创伤疼痛
E. 牙痛

正确答案：E。牙痛

解析：本题考查阿司匹林的适应证。阿司匹林可用于缓解牙痛（E对）。阿司匹林具有中等程度的镇痛作用，对慢性钝痛如牙痛、头痛、神经痛、肌肉痛、关节痛等有较好的镇痛效果，而对癌性疼痛、（A错）、分娩疼痛（B错）、内脏绞痛（C错）和严重创伤疼痛（D错）几乎无效。